银汞合金水分掺入，与什么发生化学反应，产生氢气
A. 锌
B. 铁
C. 铬
D. 氧
E. 金

正确答案：A。锌

解析：本题考查银汞合金的性能。银汞合金水分掺入，与锌（A对）发生化学反应，产生氢气。如果含锌银汞合金在调和及充填过程中被水分污染，则会产生较大的膨胀，这种膨胀通常发生在充填后的3～5天，可持续数月，膨胀可达0.4%，这种膨胀称为延迟膨胀，可能因合金中锌的与水反应产生氢气所致。因此含锌隔湿。银汞合金临床操作时必须严格。